上颌中切牙近中切角与上颌第二磨牙两侧颊尖相连而成的三角平面的斜坡是
A. 髁导斜度
B. 切导斜度
C. 补偿曲线曲度
D. 定位平面斜度
E. 牙尖斜度

正确答案：D。定位平面斜度

解析：本题考查影响平衡牙合的五因素。上颌中切牙近中切角与上颌第二磨牙两侧颊尖相连而成的三角平面的斜坡是定位平面斜度（D对）。定位平面斜度：从上颌中切牙近中切角至7⊥7的颊尖顶相连而成的三角平面称为定位平面。定位平面与眶耳平面所相交的角度称为定位平面斜度。髁导斜度（A错）为髁槽与水平面的交角，是用前伸关系记录将髁道斜度转移到牙合架上的。切导斜度（B错）为切导盘与水平面的交角，切导斜度与切道斜度相当。补偿曲线曲度（C错）：全口义齿修复中所指的补偿曲线多限于上颌7-3⊥3-7颊尖顶相连，形成凸向下的曲线。补偿曲线与眶耳平面所相交的角度称为补偿曲线曲度。牙尖斜度（E错）：当下颌作前伸运动时，下颌后牙颊尖的近中斜面和上颌后牙颊尖的远中斜面相互接触，此牙尖斜面（又称牙尖工作斜面或平衡斜面）与各自牙尖底的交角称为牙尖斜度。也就是人工牙垂直于水平面时,牙尖斜面与水平面之间的夹角。它是人工牙的固有斜度，与牙的长轴方向无关。